下列关于公共场所卫生许可证的说法正确的是
A. 有效期限为3年，每2年复核一次
B. 有效期限为4年，每2年复核一次
C. 公共场所经营者变更法定代表人的，应当向县级以上地方人民政府卫生行政部门重新申请卫生许可证
D. 公共场所经营者变更经营场所地址的，应当向原发证卫生行政部门办理变更手续
E. 公共场所经营者需要延续卫生许可证的，应当在卫生许可证有效期届满20日前，向原发证卫生行政部门提出申请

正确答案：B。有效期限为4年，每2年复核一次